研究医学心理学时，根据研究涉及的时间分类，其中不包括的是
A. 横断研究
B. 调查研究
C. 纵向研究
D. 回顾研究
E. 前瞻研究

正确答案：B。调查研究

解析：医学心理学是一门临床应用学科，其研究方法也有许多临床特点。按研究涉及的时间，可以分为横断研究、纵向研究、回顾研究和前瞻研究。B项属于根据研究涉及的手段分类。掌握“医学心理学研究方法及其应用”知识点。